气管镜检查的方位标志是
A. 气管分叉
B. 气管隆嵴
C. 左主支气管
D. 右主支气管
E. 声门裂

正确答案：B。气管隆嵴

解析：气管隆嵴是气管镜检查的方位标志（B对）。